以下有关腭裂临床表现中，不恰当的是
A. 吸吮功能障碍
B. 鼻腔内的分泌物可很自然地流入口腔
C. 易引起咽鼓管感染
D. 易发生中耳炎
E. 牙列正常

正确答案：E。牙列正常

解析：腭裂患儿常出现牙列错乱，完全性腭裂患儿常常可伴发完全性或不完全性唇裂，牙槽突裂隙的宽窄不一，有的患者牙槽突裂端口可不在同一平面上。掌握“腭裂”知识点。